既发散风寒，又燥湿止带的是
A. 荆芥
B. 防风
C. 白芷
D. 羌活
E. 细辛

正确答案：C。白芷

解析：本题考查的是白芷的功效。既发散风寒，又燥湿止带的是白芷（C对）。白芷：【功效】发散风寒，通窍止痛，燥湿止带，消肿排脓。荆芥（A错）：【功效】散风解表，透疹止痒，止血。防风（B错）：【功效】祛风解表，胜湿，止痛，解痉。羌活（D错）：【功效】解表散寒，祛风胜湿，止痛。细辛（E错）：【功效】祛风散寒，通窍，止痛，温肺化饮。